患者，男，55岁。少尿，浮肿，视物模糊2年，伴有全身乏力，皮肤干燥，腰膝酸软，口中有尿臭味，舌红少苔，脉细。检查：血压180/105mmHg，24/14kPa，血清钾6.8mmol/L，血肌酐640μmol/L。治疗应首选
A. 降压药加羚角钩藤汤
B. 降压药加镇肝熄风汤
C. 透析加杞菊地黄丸
D. 透析加天麻钩藤饮
E. 降压药加知柏地黄丸

正确答案：C。透析加杞菊地黄丸

解析：血液中的肌酐（Cr）是由外源性和内生性两类组成的。Cr的生成量相当恒定。血中Cr主要由肾小球滤过排出体外，肾小管基本不重吸收。血肌酐测定可以反映肾小球的滤过功能。本题患者少尿，浮肿，视物模糊2年，伴有全身乏力，皮肤干燥，腰膝疫软，口中有尿臭味。实验室检查：血压180/105mmHg24/14kPa，血清钾6.8mmol/L，血肌酐640μmol/L（全血Cr为88.4～176.8μmol/L；血清或血浆Cr：男性53～106μmol/L）可诊断该患者为慢性肾衰竭。因此治疗首选透析（ABE错）。慢性肾衰竭的中医辨证分型为本虚证和标实证。本题患者患者为慢性肾衰竭，肝肾亏虚，水不涵木，肝阳上亢则视物模糊；腰为肾之府，肾虚而水湿内盛，则浮肿；肾与膀胱相表里，肾阳不足，膀胱气化不利，故少尿；阴虚火旺则皮肤干燥，腰膝失于滋养，则腰膝疫软。舌红少苔，脉细为阴虚内热之象。因此本病患者是本虚证中的肝肾阴虚证，方药宜用有滋肾平肝作用的杞菊地黄丸（C对）；天麻钩藤饮具有镇肝息风的作用，适用于标实证中的肝风证（D错）。